牛黄中的化学成分属于甾体类化合物的有
A. 胆酸
B. 石胆酸
C. 牛磺酸
D. 去氧胆酸
E. 甘氨酸

正确答案：A、B、D。胆酸；石胆酸；去氧胆酸

解析：本题考查的是牛黄的化学成分。牛黄中的化学成分属于甾体类化合物的有胆酸（A对）、石胆酸（B对）与去氧胆酸（D对）。胆汁酸属于甾体类化合物。牛黄约含8%胆汁酸，主要成分为胆酸、去氧胆酸和石胆酸。此外，还含有7%SMC及胆红素，胆固醇，麦角固醇，多种氨基酸（如丙氨酸、甘氨酸（E错）、牛磺酸（C错）、精氨酸、天冬氨酸、蛋氨酸等）和无机盐等。《中国药典》以胆酸和胆红素为牛黄的质量控制成分，要求胆酸含量不少于4.0%，胆红素含量不得少于25.0%。